甲烷（CH₄）若用Cl取代CH₄上H后，其毒性最大的是
A. CH₃Cl
B. CH₂Cl₂
C. CHCl₃
D. CCl₄

正确答案：D。CCl₄

解析：本题考查甲烷（CH₄）的取代反应。化学物取代基团不同，其毒性亦可能不同。烷烃类的氢如被卤素取代，毒性增强，且取代愈多，毒性愈大。甲烷（CH₄）若用Cl取代CH₄上H后，其毒性最大的是CCl₄（D对ABC错）。